牙龈探诊出血症状最早出现在
A. 正常牙龈
B. 初期牙龈炎病损
C. 早期牙龈炎病损
D. 确立期牙龈炎病损
E. 晚期牙周炎病损

正确答案：C。早期牙龈炎病损

解析：本题考查健康牙龈到到牙周炎的发展过程。牙龈探诊出血症状最早出现在早期牙龈炎病损（C对）。健康牙龈的表现为粉色、质地坚韧致密，扇贝状紧贴牙颈部，无出血表现（A错）。健康牙龈到到牙周炎的发展过程为初期病损、早期病损、确立期病损、晚期病损四个阶段。①初期病损在24小时，龈沟内形成龈沟液，液体渗出的量与牙龈炎症程度成正比，白细胞眼趋化梯度向龈沟液移除，临床上表现为健康的牙龈（B错）；②早期病损在4-7天，淋巴细胞和中性粒细胞浸润，临床上可有炎症表现，牙龈发红，探诊出血；③确立病损期龈沟液白细胞增加，牙龈有明显炎症和红肿，颜色暗红，龈沟加深，此期可视为慢性龈炎病损（D错）；④晚期病损为牙周破坏期，形成牙周袋（E错），浆细胞是主要浸润细胞。